羚翘解毒片的适应病症有
A. 恶寒发热
B. 头晕目眩
C. 无汗，头痛
D. 鼻流清涕
E. 咳嗽，咽痛

正确答案：A、B、E。恶寒发热；头晕目眩；咳嗽，咽痛